碱基置换的后果是出现
A. 同义密码
B. 错义密码
C. 终止密码
D. 以上都对

正确答案：D。以上都对

解析：本题考查碱基置换的后果。碱基置换是指DNA多核苷酸链上某个碱基被另一种碱基取代，导致DNA碱基序列的异常。碱基置换中，无论是转换还是颠换都只涉及一对碱基，其结果可造成一个三联体密码子的改变，可能出现同义密码、错义密码、无义密码和终止密码（D对ABC错）。